诊断乳房深部脓肿的主要依据是
A. 恶寒发热，乳房触痛
B. 乳房红肿热痛
C. 穿刺抽出脓性液体
D. 局部检查有波动感
E. 超声检查提示有液平

正确答案：C。穿刺抽出脓性液体

解析：乳房深部脓肿可表现为乳房触痛，但局部检查波动感多不明显，可用超声检查或在其引导下用粗针穿刺。临床诊断乳房深部脓肿的主要依据为穿刺抽出脓性液体（C对）。恶寒发热，乳房触痛（A错）和乳房红肿热痛（B错）是急性乳腺炎的临床表现。急性乳腺炎脓已成时肿块变软，按之有波动感（D错）。B超检查（E错）可帮助辨别乳房深部脓肿，利于准确切开，但不是诊断乳房深部脓肿的主要依据。